穿经海绵窦内侧壁的脑神经是
A. III脑神经
B. Ⅳ脑神经
C. V脑神经
D. VI脑神经
E. 无

正确答案：D。VI脑神经

解析：穿经海绵窦内侧壁的脑神经是展神经，即VI脑神经（D对），而III脑神经（A错）、Ⅳ脑神经（B错）、V脑神经（C错）均穿经海绵窦外侧壁。